女，66岁。手关节痛伴晨僵3年。查体：双手近端和远端指间关节压痛，无软组织肿胀，远端指间关节变形，可见多个Heberden结节。化验：ESR22mm/h，类风湿因子22U/L（正常），抗CCP抗体阴性。X线片示远端指间关节半脱位。最可能的诊断是
A. 强直性脊柱炎
B. 骨关节炎
C. 类风湿关节炎
D. 风湿性关节炎
E. 银屑病关节炎

正确答案：B。骨关节炎

解析：患者实验室检查：ESR22mm/h，类风湿因子22U/L（正常）（排除类风湿性关节炎）（C错）。抗CCP抗体阴性，X线片示远端指间关节半脱位。最可能的诊断是骨关节炎（B对）。骨关节炎多见于50岁以上者。主要累及膝、脊柱等负重关节，活动时关节痛加重，可有关节肿、积液。手骨关节炎常多影响远端指间关节，尤其在远端指间关节出现赫伯登（Heberden）结节和近端指关节出现布夏尔（Bouchard）结节时有助诊断。大多数患者ESR正常，RF阴性或低滴度阳性。X线示关节边缘呈唇样增生或骨疣形成，如出现关节间隙狭窄多为非对称性。强直性脊柱炎（A错）主要侵犯骶髂及脊柱关节，多见于青壮年男性，外周关节受累以非对称性的下肢大关节炎为主，极少累及手关节，骶髂关节炎具典型的X线改变（P825）。可有家族史，90%以上患者HLA-B27阳性。银屑病关节炎（E错）多于银屑病若干年后发生，且表现为关节的附着端炎和手指炎，同时可有骶髂关节炎和脊柱炎。